适用于有详细账目的集体单位、过程相对简便、节省人力物力的膳食调查方法是
A. 称重法
B. 记帐法
C. 膳食回顾法
D. 化学分析法
E. 食物频数法

正确答案：B。记帐法

解析：本题考查记账法。记账法（B对ACDE错）适用于有详细账目的集体单位，过程相对简便，节省人力物力。该法通过查账或记录本单位一定时间内各种食物消耗总量和用餐人日数，计算出平均每人每日的食物消耗量，一般可统计1个月，一年四季各进行一次。